下列哪项是慢性肾炎普通型的表现
A. 中等程度蛋白尿
B. 高度水肿
C. 大量蛋白尿
D. 血脂升高
E. 血浆白蛋白降低

正确答案：A。中等程度蛋白尿

解析：慢性肾炎即慢性肾小球肾炎，系指蛋白尿、血尿、高血压、水肿为基本临床表现，根据其临床表现可分为五个亚型，分别为普通型、肾病性大量蛋白尿、高血压型、混合型及急性发作型。较为常见。病程迁延，病情相对稳定，多表现为轻度至中度的水肿（B错）、高血压和肾功能损害。尿蛋白（+）～（+++）（A对），镜下血尿和管型尿等。肾病性大量蛋白尿（AC错）除具有普通型的表现外，部分患者可表现肾病性大量蛋白尿。血脂升高（D错）和血浆白蛋白降低（E错）常见于肾病综合征（P477）患者。